胸闷心悸，息促不得卧，是因
A. 饮流四肢
B. 饮停心包
C. 饮邪犯肺
D. 饮停胃肠
E. 饮停胸胁

正确答案：B。饮停心包

解析：饮停心包，阻遏心阳，则胸闷心悸，息促不得卧（B对）。饮流四肢，则身体、肢节疼重，是溢饮的主要表现（A错）。饮邪犯肺，肺失宣降，气道滞塞，则见胸部紧闷，咳吐清稀痰涎，或喉间哮鸣有声（C错）。饮停胃肠，阻滞气机，胃失和降，可见脘腹痞胀，泛吐清水，脘腹部水声漉漉，是痰饮的主要表现（D错）。饮停胸胁，阻碍气机，肋间饱满，咳唾引痛，胸闷息促为悬饮的主要表现（E错）。